急性牙髓炎的疼痛特点不包括
A. 自发性、阵发性痛
B. 温度刺激加剧疼痛
C. 夜间痛
D. 疼痛不能定位
E. 疼痛呈放散性或牵涉性，有时可放散到患牙的对侧区

正确答案：E。疼痛呈放散性或牵涉性，有时可放散到患牙的对侧区

解析：本题考查急性牙髓炎的疼痛特点。疼痛呈放散性或牵涉性，但这种放散痛不会发生到患牙的对侧区域（E错，为本题的正确答案）。急性牙髓炎的疼痛性质具有下列特点：（1）自发性阵发性痛（A对）。（2）夜间痛（C对）。（3）温度刺激加剧疼痛（B对）。（4）疼痛不能自行定位（D对）。